改善急性左心衰竭症状最有效的药物是
A. 利尿剂
B. 洋地黄
C. 钙离子拮抗剂
D. β肾上腺素能受体阻滞剂
E. 血管紧张素转换酶抑制剂

正确答案：A。利尿剂

解析：改善急性左心衰竭症状最有效的药物应为利尿剂（A对），多采用呋塞米（速尿）静脉注射，其除了利尿外，其还可扩张静脉，有利于肺水肿的缓解。洋地黄（B错）（包含毛花苷C）最适合用于有快速心室率的心房颤动并心室扩大伴左心室收缩功能不全者，不是改善改善急性左心衰竭症状最有效的药物。钙离子拮抗剂（P174）（C错）可降低心肌细胞内钙浓度，改善心肌主动舒张功能，降低血压，改善左室早期充盈，减轻心肌肥厚，多用于舒张性心力衰竭的治疗。β肾上腺素能受体阻滞剂（P171）（D错）可抑制交感神经激活对心力衰竭代偿的不利作用，多用于慢性心力衰竭的治疗，禁用于急性左心衰竭。血管紧张素转换酶抑制剂（P171）（E错）通过抑制ACE减少血管紧张素Ⅱ生成而抑制RAAS，也可通过降低心衰患者神经-体液代偿机制的不利影响，改善心室重塑，多用于慢性心衰的治疗。